若来自多形性腺瘤上皮性成分发生恶变，则称为
A. 多形性腺瘤化生
B. 腺泡细胞癌
C. 恶性多形性腺瘤
D. 黏液表皮样癌
E. 腺样囊性癌

正确答案：C。恶性多形性腺瘤

解析：恶性多形性腺瘤又称为多形性腺瘤癌变，是来自多形性腺瘤上皮性成分的恶变。掌握“基底细胞腺瘤及恶性多形性腺瘤”知识点。